以下哪种固位体效果差
A. 嵌体
B. 3/4冠
C. 金属全冠
D. 金属烤瓷全冠
E. 桩冠

正确答案：A。嵌体

解析：本题考查固定桥的设计。嵌体（A对）属于冠内固位体，因其固位力差，外形线长，容易产生继发龋。